WHO推荐的针对主要慢性病的个体水平上的干预措施的是
A. 禁止烟草广告、促销和赞助
B. 减少加工食品中的食盐添加
C. 全面禁止使用反式脂肪
D. 接种乙肝疫苗
E. 在社区脑卒中高危人群中开展颈动脉超声筛查

正确答案：D。接种乙肝疫苗

解析：本题考查WHO推荐的针对主要慢性病的个体水平上的干预措施。WHO推荐的针对主要慢性病的个体水平上的干预措施有：接种乙肝疫苗（D对ABCE错），预防肝癌；筛查和治疗癌前病变，预防宫颈癌；对心脏病发作和脑卒中风险增加或已有心血管疾病的个体开展咨询和多药治疗（包括对糖尿病病人控制血糖）；心脏病发作（心肌梗死）时服用阿司匹林。